肛隐窝炎的并发症是
A. 肛口肿胀
B. 肛口疼痛
C. 肛口出血
D. 肛乳头炎
E. 肛口潮湿

正确答案：D。肛乳头炎

解析：肛隐窝炎的常见并发症为肛乳头炎（D对）、肛乳头肥大。其余选项为肛隐窝炎的临床症状（ABCE错）。